在预防儿童青少年伤害中，应着重抓好哪些方面的工作
A. 加强对父母、居民的安全教育
B. 利用现有疾病监测系统开展伤害监测
C. 对受伤害人群进行社区康复，避免伤残
D. 加强安全教育与社区康复同时进行
E. 促进交通部门立法

正确答案：D。加强安全教育与社区康复同时进行